体内两条电子传递链分别以不同递氢体起始，经呼吸链最后将电子传递给氧，生成水。这两条电子传递链的交叉点是
A. cytb
B. FAD
C. FMN
D. cytc
E. CoQ

正确答案：E。CoQ

解析：氧化呼吸链可分为两条途径，NADH氧化呼吸链和FADH2氧化呼吸链。CoQ参与了这两种呼吸链。掌握“氧化磷酸化”知识点。